单人心肺复苏时，胸外心挤压与人工呼吸的正确操作是
A. 心脏按压5次，口对口人工呼吸1次
B. 心脏按压6次，口对口人工呼吸1次
C. 心脏按压12次，口对口人工呼吸2次
D. 心脏按压30次，口对口人工呼吸2次
E. 心脏按压24次，口对口人工呼吸3次

正确答案：D。心脏按压30次，口对口人工呼吸2次

解析：1992年心肺复苏指南指出单人心肺复苏时，胸外心挤压与人工呼吸的正确操作是心脏按压15次，口对口人工呼吸2次（D对）。根据2010年AHA复苏指南：心脏按压与人工呼吸比为30：2。